临床上多作为过渡性义齿的为哪种义齿类型
A. 金属铸造支架式义齿
B. 黏膜支持式义齿
C. 牙与黏膜混合支持式义齿
D. 胶连式义齿
E. 牙支持式义齿

正确答案：D。胶连式义齿

解析：胶连式义齿：胶连式义齿的优点是制作工艺简单，价格低廉，便于修改和添加。临床上多作为暂时性、过渡性义齿。掌握“局部义齿类型，肯氏分类及模型观测”知识点。